外源性产褥感染的主要致病菌是
A. β-溶血性链球菌
B. 需氧性链球菌
C. 消化链球菌
D. 大肠杆菌
E. 淋病奈瑟菌

正确答案：B。需氧性链球菌